关于抗感染免疫的叙述，下列错误的是
A. 完整的皮肤与粘膜屏障是抗感染的第一道防线
B. 吞噬细胞和体液中的杀菌物质是抗感染的第二道防线
C. 体液免疫主要针对胞外寄生菌的感染
D. 细胞免疫主要针对胞内寄生菌的感染
E. 抗体与细菌结合可直接杀死病原菌

正确答案：E。抗体与细菌结合可直接杀死病原菌

解析：细菌特异性抗体可通过下述方式抵御杀灭细菌：①结合细菌后激活补体产生攻膜复合物裂解细菌；②结合细菌后通过Fc段调理吞噬细菌；③结合细菌后通过激活补体通过补体片段调理吞噬细菌；④中和细菌毒素；⑤分泌型SIgA可阻断细菌对黏膜的黏附。掌握“抗感染免疫”知识点。